河豚毒素在哪种条件下可被破坏
A. 油炸
B. 冷藏
C. 煮沸
D. 日晒盐腌
E. 加4%NaOH溶液处理20分钟

正确答案：E。加4%NaOH溶液处理20分钟